血压、脉搏属于
A. 形态指标
B. 生理功能指标
C. 生化功能指标
D. 素质指标
E. 心理指标

正确答案：B。生理功能指标